动物实验已获阳性致癌结果而人群中尚无流行病学调查资料表明对人有致癌性的物质称为
A. 可疑致癌物
B. 潜在致癌物
C. 确认致癌物
D. 二类致癌物
E. 非致癌物

正确答案：B。潜在致癌物